对乙酰氨基酚的特殊杂质
A. 二苯酮衍生物
B. 酮体
C. 苯酚
D. 对氨基酚
E. 对氨基苯甲酸

正确答案：D。对氨基酚

解析：本题考查对乙酰氨基酚的特殊杂质。由于对乙酰氨基酚的合成路线较多，不同生产工艺引入的有关杂质不尽相同，其中包括合成中间体、副产物及分解产物，如对硝基酚、对氨基酚（D对）、对氯苯乙酰胺、O-乙酰基对乙酰氨基酚、偶氮苯、氧化偶氮苯、苯醌和醌亚胺等。二苯酮衍生物（A错）是地西泮的特殊杂质。酮体（B错）和苯酚（C错）是苯乙胺类药物常见的特殊杂质。对氨基苯甲酸（E错）是普鲁卡因的特殊杂质。